不参与构成颅底
A. 枕骨
B. 额骨
C. 顶骨
D. 蝶骨
E. 筛骨

正确答案：C。顶骨

解析：颅顶额骨、顶骨和枕骨构成 （C对）。 颅底由蝶骨（D错）、枕骨（A错）、颞骨、额（B错）骨和筛骨（E错）构成。